男，43岁，三月前驾车发生交通事故其妻子死于车祸，本人受轻伤，两月来夜间反复梦见车祸现场，不敢看电视报道，不敢驾车，精神萎靡，终日酗酒，属于
A. 抑郁症
B. 焦虑症
C. 创伤后应激障碍
D. 急性应激障碍
E. 适应障碍

正确答案：C。创伤后应激障碍

解析：创伤后应激障碍PTSD四大核心症候群：1.侵入性症候群；2.持续性回避（C对）；3.认知和心境的负性改变；4.警觉性增高。